评价某诊断试验诊断某病的价值时，研究对象必须为
A. 一组被金标准确诊的该病患者和一组被金标准排除该病的健康人
B. 一组被金标准确诊的该病患者和一组被金标准排除该病而且未患能影响试验结果的疾病的人
C. 一组被金标准确诊的该病患者和一组被金标准排除该病的其他疾病患者
D. 一组被金标准确诊的该病患者
E. 到医院就诊的患者

正确答案：B。一组被金标准确诊的该病患者和一组被金标准排除该病而且未患能影响试验结果的疾病的人

解析：本题考查诊断试验的研究对象。评价某诊断试验诊断某病的价值时，研究对象必须为一组被金标准确诊的该病患者和一组被金标准排除该病而且未患能影响试验结果的疾病的人（B对ACDE错）。